糖尿病的诊断是糖尿病症状加上随机血糖
A. ≥7.1mmol／L
B. ≥9.1mmol／L
C. ≥10.1mmol／L
D. ≥11.1mmol／L
E. ≥12.1mmol／L

正确答案：D。≥11.1mmol／L

解析：糖尿病症状加上随机血糖≥11.1mmol/L（D对）或空腹血糖（FPG）≥7.0或OGTT2小时血糖≥11.1mmol/L可诊断为糖尿病。